苯二氮䓬类药物的作用机制是
A. 抑制中枢神经细胞Cl⁻通道，减少Cl⁻流入细胞
B. 抑制中枢神经细胞Na⁺通道，减少Na⁺流入细胞
C. 影响中枢胆碱受体
D. 影响中枢多巴胺受体
E. 影响中枢γ-氨基丁酸受体

正确答案：E。影响中枢γ-氨基丁酸受体

解析：本题考查苯二氮䓬类药物的作用机制。苯二氮䓬类药物的作用机制是影响中枢γ-氨基丁酸受体（E对）。苯二氮䓬类药物通过非选择性激动γ-氨基丁酸受体A（GABAA）上不同的α亚基发挥作用。